正确描述隐神经的是
A. 是闭孔神经的一个分支
B. 发出一支管理股内侧区皮肤感觉
C. 在股部与大隐静脉伴行
D. 管理小腿内侧面皮肤感觉
E. 属纯感觉纤维

正确答案：D。管理小腿内侧面皮肤感觉

解析：隐神经是股神经发出的皮支（AE错），伴随股动脉进入收肌管下行，出此管后在膝关节内侧继续下行，于缝匠肌下端的后方浅出至皮下。随后与大隐静脉伴行沿小腿内侧面下行至足内侧缘（C错），沿途发出分支分布于髌下、小腿内侧面及足内侧缘的皮肤（B错D对）。